金荞麦和半枝莲均有的功效是
A. 祛痰
B. 排脓
C. 止血
D. 利水
E. 散瘀

正确答案：E。散瘀

解析：本题考查的是金荞麦和半枝莲的功效。金荞麦和半枝莲均有的功效是散瘀（E对）。金荞麦：【功效】清热解毒，祛痰（A错）排脓（B错），散瘀止痛。半枝莲：【功效】清热解毒，散瘀止血（C错），利水（D错）消肿。